甲氧苄啶抗菌作用机制是
A. 抑制RNA聚合酶
B. 抑制二氢叶酸还原酶
C. 抑制二氢叶酸合成酶
D. 抑制拓扑异构酶IV
E. 抑制肽酰基转移酶

正确答案：B。抑制二氢叶酸还原酶

解析：本题考查药物的作用机制。甲氧苄啶通过抑制细菌二氢叶酸还原酶的合成（B对）抑制细菌的生长繁殖。